有关脊髓骶节的描述,正确的是
A. 有薄束和楔束
B. 有交感神经节前神经元
C. 有楔束无薄束
D. 有副交感神经节前神经元
E. 没有皮质脊髓侧束

正确答案：D。有副交感神经节前神经元

解析：薄束起自同侧第5胸节及以下的脊神经节细胞，腰部楔束起自同侧第4胸节及以上的脊神经节细胞，薄束和楔束均为上行纤维束，不到达骶节（AC错）。皮质脊髓侧束在脊髓外侧索后部下行，直至骶髓（E错）。骶部含有副交感神经节前纤维（D对），分布到盆丛。